确定某因素与某病发生因果关系时，下列哪一条不考虑
A. 联系的强度和联系的特异性
B. 剂量反应和关联的合理性
C. 时间顺序，即暴露发生于疾病之前
D. 对联系进行统计学检验所得的P值大小
E. 关联的重复性

正确答案：D。对联系进行统计学检验所得的P值大小